下列各项，不属于寒淫证范畴的是
A. 外寒证
B. 伤寒证
C. 中寒证
D. 虚寒证
E. 里寒证

正确答案：D。虚寒证

解析：寒淫证常分为伤寒证和中寒证。伤寒证是指寒邪外袭肤表，阻遏卫阳所表现的表实寒证，又称风寒表证、外寒证；中寒证是指寒邪直中于里，伤及脏腑、气血，遏制并损伤阳气，阻滞脏腑气机和血液运行所表现的里实寒证，又称内寒证、里寒证等（D错，为本题正确选项）。